下列哪种说法是正确的
A. 母气有余而乘其子
B. 子气有余而乘其母
C. 气有余而乘己所胜
D. 气有余则乘己所不胜
E. 气不及则己所胜侮而乘之

正确答案：C。气有余而乘己所胜

解析：本题考查五行生克与乘侮规律，属于理解记忆内容。相乘与相侮的主要区别是：前者是按五行的相克次序发生过度的克制，后者是与五行相克次序发生相反方向的克制现象。两者之间联系是：在发生相乘时，也可同时发生相侮；发生相侮时，也可同时发生相乘。《素问·五运行大论》说：“气有余，则制己所胜（C对）而侮所不胜（D错）；其不及，则己所不胜，侮而乘之，己所胜，轻而侮之（E错）”。母与子的关系不能用乘侮规律解释，而是用母子相即规律来解释。母生子，母气有余而滋养其子（A错）。子气有余可以导致母行亢盛，也可损伤母行，不能说子气有余而乘其母（B错）。五行的相乘和相侮，都是不正常的相克现象，两者之间既有区别又有联系。